急性肺血栓栓塞患者，确定溶栓治疗的主要依据指标是
A. 右室大小
B. 右心功能
C. 氧合指数
D. 心肌坏死标志物
E. 血压状况

正确答案：E。血压状况

解析：对高危（大面积）PTE，其特征为右心室功能不全，伴低血压或心源性休克，此类患者在没有溶栓禁忌症的情况下应积极、迅速的给予溶栓治疗，对中危（次大面积）PTE（血压正常，有右心功能不全表现）是否溶栓应根据每例患者的具体情况，做出个体化治疗决定，对低危（非大面积）PTE（血压正常，无右心室功能不全）目前一致认为不应行溶栓治疗，故急性肺栓塞患者确定是否溶栓的主要依据指标为血压情况（E对）。溶栓可迅速缓解部分或全部血栓，恢复肺组织再灌注，减少肺动脉阻力，减低肺动脉压，改善右心室功能，减少严重肺栓塞患者的病死率和复发率，对有溶栓指证的病例应尽早开始溶栓。